下列关于咽的说法，何者错误
A. 上至颅底
B. 下平第6颈椎体下缘
C. 从上而下依次为鼻咽，喉咽和口咽
D. 向前通鼻腔、口腔和喉腔
E. 下续食管

正确答案：C。从上而下依次为鼻咽，喉咽和口咽

解析：咽上起于颅底(A对)，下平第6颈椎体下缘(B对)或环状软骨，自上而下分别为鼻咽，口咽和喉咽(C错，为本题正确答案)，向前与鼻腔、口腔和喉腔相通(D对)，在下端第6颈椎体下缘或环状软骨处与食管相续(E对)。